关于唾液腺肿瘤以下哪种说法是正确的
A. 腮腺肿瘤80％发生于腮腺深叶
B. 颌下腺良性肿瘤全是混合瘤
C. 舌下腺肿瘤良性多见
D. 小涎腺肿瘤大部分发生于腭部
E. 涎腺肿瘤大多数发生在小涎腺

正确答案：D。小涎腺肿瘤大部分发生于腭部

解析：本题考查唾液腺肿瘤。小涎腺肿瘤大部分发生于腭部（D对），一般发生于一侧腭后部及软硬腭交界处，此处含有腭腺。腮腺肿瘤80％发生于腮腺浅叶（A错），表现为耳垂下、耳前区后腮腺后下部的肿块。颌下腺良性肿瘤除了混合瘤，也可能是腺淋巴瘤、肌上皮瘤、嗜酸性粒细胞腺瘤等（B错）。舌下腺肿瘤很少见，但一旦发生，很可能是腺样囊性癌，为恶性肿瘤（C错）。涎腺肿瘤大多数发生在腮腺（E错），占80%，其次为下颌下腺，占10%，舌下腺占1%，小唾液腺占9%。